促进复极4相K⁺外流，相对延长有效不应期的药物是
A. 奎尼丁
B. 普萘洛尔
C. 利多卡因
D. 维拉帕米
E. 苯妥英钠

正确答案：C。利多卡因